HBL值3～８的表面活性剂适宜用于
A. 助溶剂
B. 润湿剂
C. O/W型乳化剂
D. 增溶剂
E. W/O型乳化剂

正确答案：E。W/O型乳化剂

解析：本题考查的是表面活性剂的应用。HBL值3～8的表面活性剂适宜用于W/O型乳化剂（E对）。表面活性剂系指分子中同时具有亲水基团和亲油基团，具有很强的表面活性，能使液体的表面张力显著下降的物质。表面活性剂中亲水、亲油基因对油和水的综合亲和力，称为亲水亲油平衡值（HLB）。表面活性剂的应用：表面活性剂常用做增溶剂、乳化剂、润湿剂、起泡剂、消泡剂以及去污剂、抑菌剂或消毒剂等。（1）增溶剂（D错）：利用表面活性剂的两亲性形成胶团或胶束，可增加难溶性药物的溶解度，改善制剂的澄明度，提高制剂的稳定性。HLB值在15～18的表面活性剂适合用作增溶剂。（2）乳化剂：使两种或两种以上互不相溶的组合的混合液体形成稳定的乳状液。HLB值在8～16的表面活性剂适合用作O/W型乳化剂（C错）；HLB值在3～8的表面活性剂适合用作W/O型乳化剂。（3）润湿剂（B错）：可提高饮片表面的润湿性而促进浸提、提高片剂的表面润湿性而加快崩解、提高混悬微粒的表面润湿性而促进分散等。HLB值在7～9的表面活性剂适合用作润湿剂。（4）起泡与消泡剂：起泡剂具有发泡作用或稳定泡沫的作用，通常具有较高的HLB值和较强的亲水性，常用于腔道给药和皮肤给药。含有皂苷、树胶及具有表面活性高分子化合物的饮片，在浸提、浓缩时产生稳定的泡沫而影响操作，为了破坏泡沫，可加入少量表面张力小且亲水性小的戊醇、辛醇、醚类、硅酮类或HLB值通常为1～3的表面活性剂（消泡剂）替代泡沫表面原来的表面活性物质（起泡剂），使泡沫破坏。（5）去污剂：去污剂最适宜表面活性剂的HLB值为13～16，其中，去污能力最强的是非离子型表面活性剂，其次为阴离子型表面活性剂。（6）消毒剂和抑菌剂：大多数阳离子和两性离子型表面活性剂可以用作消毒剂。表面活性剂常用做助溶剂（A错），2022年考试指南未明确说明。